温热性表示药物具有的作用是
A. 凉血
B. 利湿
C. 理气
D. 温里
E. 安蛔

正确答案：D。温里

解析：本题考查的是药物四气的所示效用。温热性表示药物具有的作用是温里（D对）。四气，从本质而言只有寒热二性。凡寒凉性药物，即表示其具有清热、泻火、凉血（A错）、解热毒等作用；凡温热性药物，即表示其具有温里散寒、补火助阳、温经通络、回阳救逆等作用。四气对人体的作用也有两面性，倘若应用不当，即可对人体产生不良作用。此时，寒凉性有伤阳助寒之弊，而温热性则有伤阴助火之害。